病例和对照均来自于医院的病例对照研究，最易出现的偏倚是
A. 信息偏倚
B. 选择偏倚
C. 观察偏倚
D. 混杂偏倚
E. 诊断偏倚

正确答案：B。选择偏倚

解析：本题考查选择偏倚的相关内容。入院率偏倚指以医院为基础的病例对照研究中，目标疾病的入院率因待研究的暴露因素的存在与否或暴露水平的不同而存在差异，由此而引起的误差。入院率偏倚也称伯克森偏倚，属于流行病学中病例对照研究的一种选择偏倚（B对ACDE错）。